某女，32岁。月经周期延后，量少，色淡红，质黏稠，头晕，心悸气短，脘闷恶心，口腻多痰，带下量多黏腻；舌淡胖苔白腻，脉滑。宜选用的基础方剂是
A. 芎归二陈汤
B. 归肾丸
C. 乌药汤
D. 归脾汤
E. 大补元煎

正确答案：A。芎归二陈汤

解析：本题考查的是月经后期的辨证论治。某女，32岁。月经周期延后，量少，色淡红，质黏稠，头晕，心悸气短，脘闷恶心，口腻多痰，带下量多黏腻；舌淡胖苔白腻，脉滑。宜选用的基础方剂是芎归二陈汤（A对）。月经后期：月经周期延后7天以上，甚至3～5个月一行者，称为“月经后期”。既往亦有称“经行后期”“月经延后”“月经错后”“经迟”等。一般认为要连续出现两个周期以上，若每次仅延后三五天，或偶然延后一次，下次仍如期来潮者，均不作月经后期论。此外，如在月经初潮后1年内，或月经将绝之时，周期时有延后，且无其他症状者，亦不作病论。西医学的月经稀发表现为上述症状者，可参考此内容辨证论治。（一）肾虚证：【症状】月经周期延后，经量少，色暗淡，质清稀，或带下清稀；腰膝酸软，头晕耳鸣，面色晦暗，或面部暗斑。舌淡，苔薄白，脉沉细。【方剂应用】基础方剂为归肾丸（菟丝子、茯苓、山药、熟地、杜仲、当归、山茱萸、枸杞子）加减（B错）。（二）血虚证：【症状】月经周期延后，经量少，色淡红，质清稀，或小腹绵绵作痛；或头晕眼花，心悸少寐，皮肤不润，面色苍白或萎黄。舌质淡红，苔薄白，脉细弱。【方剂应用】基础方剂为大补元煎（人参、山药、熟地、杜仲、当归、山茱萸、枸杞子、炙甘草）加减（E错）。（三）气滞证：【症状】月经周期延后，量少或正常，色暗红或有血块，小腹胀痛；或精神抑郁，胸胁乳房胀痛。舌质正常或红，苔薄白或微黄，脉弦或弦数。【方剂应用】基础方剂为乌药汤（乌药、香附、木香、当归、甘草）加减（C错）。（四）痰湿证：【症状】月经周期延后，量少，色淡红，质黏稠；头晕体胖，心悸气短，脘闷恶心，口腻多痰，或带下量多黏腻。舌淡胖，苔白腻，脉滑。【方剂应用】基础方剂为芎归二陈汤（陈皮、半夏、茯苓、甘草、川芎、当归）加减。月经先期脾气虚证：【症状】月经周期提前，经量多，色淡红，质清稀；神疲乏力，气短懒言，小腹空坠，纳少便溏。舌淡红，苔薄白，脉细弱。【方剂应用】基础方剂为补中益气汤（黄芪、炙甘草、人参、当归、橘皮、升麻、柴胡、白术）或归脾汤（D错）（人参、黄芪、白术、当归、茯神、龙眼肉、酸枣仁、木香、远志、甘草、生姜、大枣）加减。